健康教育的重点在于
A. 个体健康
B. 群体健康
C. 个体与群体的结合
D. 重点解决危险因素
E. 重点解决环境问题

正确答案：B。群体健康